治疗肝阳偏亢，肝风上扰，头痛，眩晕，失眠，应首选
A. 镇肝熄风汤
B. 天麻钩藤饮
C. 羚角钩藤汤
D. 大定风珠
E. 地黄饮子

正确答案：B。天麻钩藤饮

解析：天麻钩藤饮证系由肝肾不足，肝阳偏亢，生风化热所致。肝阳偏亢，风阳上扰，故头痛、眩晕；肝阳有余，化热扰心，故心神不安、失眠多梦。证属本虚标实，而以标实为主；治以平肝息风为主，佐以清热安神、补益肝肾之法，用天麻钩藤饮治疗（B对）。镇肝熄风汤（A错）的功用为镇肝息风，滋阴潜阳，主治类中风。羚角钩藤汤（C错）的功用为凉肝息风，增液舒筋，主治肝热生风证。大定风珠（D错）的功用为滋阴息风，主治阴虚风动证。地黄饮子（E错）的功用为滋肾阴，补肾阳，开窍化痰，主治喑痱。